阿司匹林哮喘形成的原因是
A. 直接刺激作用
B. 水杨酸中毒
C. 白三烯等脂氧酶代谢产物增多
D. 能抑制血小板聚集凝血酶原形成
E. 抑制胃黏膜PG合成

正确答案：C。白三烯等脂氧酶代谢产物增多

解析：某些哮喘患者服用阿司匹林或其他解热镇痛药后可诱发哮喘，称为"阿司匹林哮喘"。其发病机制是由于阿司匹林抑制支气管平滑肌COX，使PGs合成减少，使白三烯及其他脂氧酶代谢产物增多，导致支气管痉挛，诱发哮喘（C对）。